在临床使用过程中，防止输液微粒污染的方法是
A. 严格控制原料药的质量
B. 严格控制辅料的质量
C. 合理安排工序，加强生产过程管理
D. 严格灭菌条件，严密包装
E. 在输液器中安置孔径不大于0.8㎛的终端滤膜过滤器

正确答案：E。在输液器中安置孔径不大于0.8㎛的终端滤膜过滤器

解析：本题考查输液中存在的主要问题及解决办法。在输液器中安置终端过滤器（0.8㎛孔径的薄膜）（E对），可以解决使用过程中微粒污染问题。